赤芍来源于
A. 五加科
B. 毛茛科
C. 萝藦科
D. 唇形科
E. 菊科

正确答案：B。毛茛科

解析：本题考查的是赤芍的来源。赤芍来源于毛茛科（B对）。赤芍：【来源】为毛茛科植物芍药及川赤芍的干燥根。来源于五加科（A错）的中药有人参、红参、三七、通草等。来源于萝藦科（C错）的中药有徐长卿、白前、白薇、香加皮。来源于唇形科（D错）的中药有丹参、黄芩、紫苏叶、广藿香、荆芥、益母草、薄荷、半枝莲、香薷等。来源于菊科（E错）的中药有木香、川木香、白术、苍术、紫菀、艾叶、款冬花、菊花、红花、牛蒡子、茵陈、青蒿、大蓟、蒲公英等。